睾丸素在17α位增加一个甲基，其设计的主要考虑是
A. 可以口服
B. 雄激素作用增强
C. 雄激素作用降低
D. 蛋白同化作用增强
E. 增强脂溶性，有利吸收

正确答案：A。可以口服

解析：本题考查睾丸素。睾丸素又称为睾酮，在睾酮的17α位引入甲基，增大17位的代谢位阻，得到可口服（A对）的甲睾酮。将17位的羟基进行酯化，可增加其脂溶性，减慢代谢速度（E错）。将睾酮19位甲基去除，得到苯丙酸诺龙，可显著降低雄性激素作用（C错），提高蛋白同化作用（D错）。天然雄激素有睾酮和雄烯二醇，其中睾酮的活性最强，雄烯二醇可转化为睾酮，从而增加雄激素作用（B错）。